在奇经八脉中，其循行多次与手、足三阳经及阳维脉交会的经脉是
A. 冲脉
B. 任脉
C. 督脉
D. 阴维脉
E. 阳跷脉

正确答案：C。督脉

解析：督脉（C对）其循行多次与手、足三阳经及阳维脉交会，为“阳脉之海”，其中大椎穴是手足三阳经的交会穴；冲脉（A错）、任脉（B错）行于腹部，与阳经无交汇；阴维脉（D错）主一身之里，具有维系一身阴经的作用；阳跷脉（E错）主肢体左右的阴阳，调节下肢运动与睡眠。